诊断下列疾病，采用的血清学诊断方法，哪项是错误的
A. 伤寒-肥达反应
B. 风湿热-抗链球菌溶血素O试验
C. 立克次体-外斐实验
D. 淋病奈瑟球菌-ELISA
E. 结核-结核菌素试验

正确答案：E。结核-结核菌素试验

解析：肥达试验是辅助诊断伤寒或副伤寒的血清学试验。抗链球菌溶血素O试验，用于风湿热辅助诊断。检测立克次体使用外斐实验。以ELISA或RIA法检测A族链球菌、淋病奈瑟球菌及肺炎链球菌抗原，以IF法检测志贺菌、霍乱弧菌感染等，均已应用于临床诊断。而结核菌素试验是对于接种卡介苗后免疫效果的评价，或者婴幼儿结核病诊断的参考指标。并不能检测出结核分枝杆菌。掌握“细菌学、血清学诊断及感染防治”知识点。